乙肝的平均潜伏期为
A. 2周～1个月
B. 1～2个月
C. 2～3个月
D. 3～4个月
E. 4～6个月

正确答案：C。2～3个月

解析：本题考查乙肝的潜伏期。乙肝的潜伏期一般为30～120天，平均60～90天，即2～3个月（C对ABDE错），最短的为2周，极少数可长达9个月。